下列情况属于违法情形的有
A. 丙药材公司发运的中药材的包装上注明品名、产地、日期、调出单位、质量合格标志
B. 甲药品经营企业销售甘草注明是道地药材，但未注明产地
C. 张某在中药材专业市场租摊位销售中药饮片
D. 乙药品经营企业从药品批发企业购进饮片分包装后，重新贴签销售

正确答案：B、C、D。甲药品经营企业销售甘草注明是道地药材，但未注明产地；张某在中药材专业市场租摊位销售中药饮片；乙药品经营企业从药品批发企业购进饮片分包装后，重新贴签销售

解析：本题考查的是中药材销售管理。下列情况属于违法情形的有甲药品经营企业销售甘草注明是道地药材，但未注明产地（B对）；张某在中药材专业市场租摊位销售中药饮片（C对）；乙药品经营企业从药品批发企业购进饮片分包装后，重新贴签销售（D对）。药品生产企业销售中药材，必须标明产地。发运中药材必须有包装。在每件包装上，必须注明品名、产地、日期、调出单位，并附有质量合格的标志（A错）。中药材专业市场管理：《药品管理法》及其实施条例规定，城乡集市贸易市场可以出售中药材，国务院另有规定的除外。另外，《关于进一步加强中药材管理的通知》指出：除现有17个中药材专业市场外，各地一律不得开办新的中药材专业市场。中药材专业市场所在地人民政府要按照“谁开办，谁管理”的原则，承担起管理责任，明确市场开办主体及其责任。中药材专业市场要建立健全交易管理部门和质量管理机构，完善市场交易和质量管理的规章制度，逐步建立起公司化的中药材经营模式。要构建中药材电子交易平台和市场信息平台，建设中药材流通追溯系统，配备使用具有药品现代物流水平的仓储设施设备，提高中药材仓储、养护技术水平，切实保障中药材质量。严禁销售假劣中药材，严禁未经批准以任何名义或方式经营中药饮片、中成药和其他药品，严禁销售国家规定的27种毒性药材，严禁非法销售国家规定的42种濒危药材。中药材市场经营者应完善购进记录、验收、储存、运输、调剂、临方炮制等过程的管理制度和措施。严禁从事饮片分包装、改换标签等活动。严禁从中药材市场或其他不具备饮片生产经营资质的单位或个人采购中药饮片，确保中药饮片安全。